1周岁小儿的平均身长为
A. 50cm
B. 60cm
C. 90cm
D. 85cm
E. 75cm

正确答案：E。75cm

解析：一般1岁时达75cm，2岁时达87cm，2岁后到12岁前（青春期前）平均每年约增加6～7cm，青春期身高加速增长。故此题选择E项。掌握“体格生长常用指标”知识点。